初产妇，宫口开全1.5小时，胎头已达盆底，持续性横左枕位。处理应是
A. 催产素静脉滴注
B. 等其自然回转
C. 人工协助顺时针转90°
D. 人工协助逆时针转90°
E. 行会阴后-斜切开术

正确答案：D。人工协助逆时针转90°

解析：正常情况下，枕左前位分娩时，当胎头到达中骨盆平面时应进行内旋转（胎头向前向中线旋转45°），使胎头较大的前后径与中骨盆及骨盆出口较大的前后径相一致，以便胎头继续下降。本例为枕左横位，为使其与正常枕左前位内旋转后一致，应人工协助逆时针转90°（D对BC错）。行会阴侧切开术（E错）是在转为枕前位有困难而向后转为枕后位娩出时，为避免会阴裂伤需要做的。催产素静脉滴注在第一产程及第三产程中宫缩乏力时应用（A错）。